患者，男，45岁，因消化不良（上腹饱胀，餐后明显）来药店咨询。下列说法错误的是
A. 应除外器质性疾病
B. 可用助消化药对症治疗
C. Hp感染是引起消化不良的常见原因
D. 进餐时不要摄入过多的液体
E. 低脂饮食，同时避免摄入过多的膳食纤维

正确答案：C。Hp感染是引起消化不良的常见原因

解析：本题考查消化不良。幽门螺杆菌（Hp）感染可能只是一小部分FD发病的原因（C错，为本题正确答案），根除幽门螺杆菌不能使多数FD症状得到缓解。消化不良是一组表现在上腹的临床症候群，包括持续性或复发性上腹疼痛或不适（上腹饱胀、早饱、烧灼感，嗳气、食欲缺乏、恶心、呕吐等）。根据病因分为器质性消化不良和功能性消化不良（FD）。首先要除外器质性疾病（A对）所致的继发性消化不良，如胃部病变（消化性溃疡、胃癌），肝（肝炎、脂肪肝、肝硬化）、胆囊及胰腺病变等腹腔器官病变，以及全身性疾病（儿童缺锌、糖尿病、贫血、甲减、抑郁等）。治疗原则为对症处理，寻找发病因素，特别是对于可逆性因素及时干预；对于中老年人要警惕器质性疾病，尽早针对原发病进行治疗；老年人与衰老有关，需要调整生活方式与其生理状态相适应，如少食多餐；因胃容受性扩张能力下降者，进餐时不要摄入过多液体（D对），每天分6～8次饮水，每次约200ml；低脂饮食，同时避免摄入过多的膳食纤维（E对）；鼓励活动，对于嗳气症和吞气症做行为指导。消化不良可用助消化药对症治疗（B对）。